构成世界的本原是
A. 天气
B. 精气
C. 阳气
D. 水精
E. 地气

正确答案：B。精气

解析：精，又称精气，是构成宇宙万物的本原（B对）。天气是指在较短时间内特定地区的大气状况（A错）。阳气是人体物质代谢和生理功能的原动力，是人体生殖、生长、发育、衰老和死亡的决定因素，人的正常生存需要阳气支持（C错）。水精：水的精气（D错）。地气指饮食五谷之气，指阴气，指在泉之气，指主气（E错）。